根据药物对胎儿的危害，美国FDA将妊娠用药毒性分为A、B、C、D、X五个级别。头孢曲松的妊娠毒性分级是
A. C级
B. D级
C. A级
D. X级
E. B级

正确答案：E。B级

解析：本题考查药毒性分级。根据药物对胎儿的危害，美国FDA将妊娠用药毒性分为A、B、C、D、X五个级别。头孢曲松的妊娠毒性分级是B级（E对）。FDA根据药物对胎儿的危害程度将妊娠用药分为A、B、C、D、X五个级别，A～X级致畸系数递增。B级是指在动物生殖试验中并未显示对胎儿的危险，但无孕妇的对照组；或对动物生殖试验显示有副作用（较不育为轻），但在早孕妇女的对照组中并不能肯定其不良反应（并在妊娠中、晚期亦无危险的证据）。如青霉素、阿莫西林、头孢曲松、红霉素、二甲双胍等。C级（A错）是指在动物研究中证实对胎儿有不良反应（致畸或使胚胎致死或其他不良事件），但在妇女中无对照组或在妇女和动物研究中无可以利用的资料，药物仅在权衡对胎儿的利大于弊时给予。如万古霉素、奥美拉唑、氨氯地平等。D级（B错）是指对人类胎儿的危险有肯定的证据，仅在对孕妇肯定有利时，方予应用（如生命垂危或疾病严重而无法应用较安全的药物或药物无效）。如氯霉素、卡马西平、依那普利等。A级（C错）是指在有对照组的早期妊娠妇女中未显示对胎儿有危险（并在中、晚期妊娠中亦无危险的证据），可能对胎儿的伤害极小。如各种水溶性维生素、正常剂量的脂溶性维生素A、维生素D、枸橼酸钾、氯化钾等。X级（D错）是指动物或人的研究中已证实可使胎儿异常，或基于人类的经验知其对胎儿有危险，对母体或对两者均有害，而且该药物对孕妇的危险明显大于益处，禁用于已妊娠或计划妊娠的妇女。如沙利度胺、辛伐他汀、利巴韦林等。